患者，男性，车祸伤及头部，伤后出现左侧鼻唇沟变浅，鼻出血，左耳听力下降，左外耳道流出淡血性液体。诊断首先考虑
A. 颅前窝骨折
B. 颅中窝骨折
C. 颅后窝骨折
D. 左颞骨骨折
E. 脑震荡

正确答案：B。颅中窝骨折

解析：男性患者，头部外伤后出现左侧鼻唇沟变浅（面神经受损的表现），鼻出血，左耳听力下降（听神经受损的表现），左外耳道流出淡血性液体（脑脊液耳漏的表现），结合患者病史和临床表现，首先考虑为左侧颅中窝骨折（B对）。颅前窝骨折（A错）因出血进入眶内，积聚在眼睑和球结膜下形成瘀血斑，形成特征性的“熊猫眼”或“眼镜征”，并可出现脑脊液鼻漏。颅后窝骨折（C错）主要表现为乳突和枕下部皮下淤血（Battle征），或在咽后壁发现黏膜下淤血，但无脑脊液鼻漏或耳漏。左颞骨骨折（D错）无脑膜破裂，不会出现脑脊液漏。脑震荡（E错）为最轻的脑损伤，典型表现为伤后立即出现的短暂意识障碍（一般不超过半小时）和近事遗忘，不会出现脑脊液漏。